未经批准擅自开办医疗机构行医给患者造成损害的，依法
A. 承担赔偿责任
B. 依法追究刑事责任
C. 吊销其执业证书
D. 者责令暂停6个月以上1年以下
E. 警告

正确答案：A。承担赔偿责任

解析：未经批准擅自开办医疗机构行医或者非医师行医的，由县级以上人民政府卫生行政部门予以取缔，没收其违法所得及其药品、器械，并处10万元以下的罚款；对医师吊销其执业证书；给患者造成损害的，依法承担赔偿责任；构成犯罪的，依法追究刑事责任。掌握“医师执业规则及培训、考核及法律责任”知识点。